与甲醛-硫酸反应用于鉴别的是
A. 阿司匹林
B. 庆大霉素
C. 苯巴比妥
D. 硫喷妥钠
E. 司可巴比妥

正确答案：C。苯巴比妥

解析：本题考查巴比妥类药物的鉴别试验。苯巴比妥（C对）与甲醛-硫酸反应，生成玫瑰红色产物。巴比妥和其他无芳环取代的巴比妥类药物无此反应，可供区别。